根据药物在体内的相互作用，其中不属于拮抗作用的是
A. 药理性拮抗
B. 生理性拮抗
C. 生化性拮抗
D. 化学性拮抗
E. 无关性拮抗

正确答案：E。无关性拮抗

解析：拮抗作用指药物合用后原有作用或毒性减弱。根据其产生机制可分为4种情况，即药理性拮抗（A对）、生理性拮抗（B对）、生化性拮抗（C对）、化学性拮抗（D对）（E错，为本题正确答案）。